不属于自我控制菌斑方法的是
A. 牙刷刷牙
B. 牙线法
C. 漱口药含漱法
D. 洁治法
E. 牙签清洁法

正确答案：D。洁治法

解析：本题考查菌斑控制的方法。不属于自我控制菌斑方法的是洁治法（D错，为本题的正确答案）。洁治有龈上洁治和龈下刮治，是口腔医师用器械去除菌斑和牙石，不是自我控制菌斑的方法，但均属牙周炎的基础治疗。刷牙是自我控制菌斑的主要手段（A对）,除刷牙外，还须辅助以其他工具和方法，如牙线（B对）、间洗刷、牙签（E对）、冲牙器等，才能彻底清除菌斑。化学药物控制菌斑，如洗必泰溶液，它是一种广谱抗菌剂（C对）。